根据《野生药材资源保护管理条例》，资源严重减少的主要常用野生药材对应的物种属于
A. 二级保护野生药材物种
B. 一级保护野生药材物种
C. 三级保护野生药材物种
D. 中药品种保护物种

正确答案：C。三级保护野生药材物种

解析：本题考查的是国家重点保护野生药材物种的分级和管理。根据《野生药材资源保护管理条例》，资源严重减少的主要常用野生药材对应的物种属于三级保护野生药材物种（C对）。国家重点保护野生药材物种的分级：国家重点保护的野生药材物种分为三级管理。一级保护野生药材物种（B错）：系指濒临灭绝状态的稀有珍贵野生药材物种。二级保护野生药材物种（A错）：系指分布区域缩小，资源处于衰竭状态的重要野生药材物种。三级保护野生药材物种：系指资源严重减少的主要常用野生药材物种。国家重点保护的野生药物种名录共收载了野生药材物种76种，中药材42种。其中一级保护的野生药材物种有4种，中药材4种；二级的野生药材物种27种，中药材17种；三级保护的野生药材物种45种，中药材21种。中药保护品种（D错）：对受保护的中药品种分为一级和二级进行管理。中药一级保护品种的保护期限分别为30年、20年、10年，中药二级保护品种的保护期限为7年。